属于乙酰胆碱脂酶抑制剂，用于改善脑功能及抗记忆障碍的药物
A. 尼莫地平
B. 吡拉西坦
C. 依达拉奉
D. 多奈哌齐
E. 尼麦角林

正确答案：D。多奈哌齐

解析：本题考查多奈哌齐。属于乙酰胆碱脂酶抑制剂，用于改善脑功能及抗记忆障碍的药物是多奈哌齐（D对）；尼莫地平（A错）属于钙通道阻滞剂，用于高血压；吡拉西坦（B错）为酰胺类脑功能改善及抗记忆障碍药；依达拉奉（C错）为自由基清除剂，用于脑梗塞急性期治疗；尼麦角林（E错）属于直接作用于血管平滑肌的血管扩张剂。